成年患者输注1单位红细胞估计可提高的血红蛋白数量是
A. 3
B. 1
C. 10
D. 7
E. 5

正确答案：E。5

解析：1单位红细胞是指200ml全血中的全部红细胞。以成年男子为例，总血容量为5000ml，含25单位红细胞，其血红蛋白数量为120g/L。故成人每输1单位红细胞可提高Hb5g/L（120/25=4.8）（E对）。此外，一袋全血（400ml）输给一个60kg体重非出血的贫血病人，大约可提升血红蛋白10g/L（黄家驷外科学P390），即200ml全血可提升血红蛋白5g/L。